舌隆突支托凹位于尖牙舌隆突上，位于
A. 颊面颈1/3和中1/3交界处
B. 舌面颈1/3和中1/3交界处
C. 颊面颈2/3和中1/3交界处
D. 舌面颈2/3和中1/3交界处
E. 舌面颈1/3和颊面1/3交界处

正确答案：B。舌面颈1/3和中1/3交界处

解析：本题考查局部义齿修复前的准备及牙体预备。舌隆突支托凹预备：舌隆突支托凹位于尖牙舌隆突上，在舌面颈1/3和中1/3交界处（B对），呈V字形。可用粗的平头柱状或倒锥车针预备，支托凹底面圆钝，最后磨光。